肠梗阻非手术治疗中，矫正全身生理紊乱的主要措施是
A. 纠正水、电解质素乱和酸碱失衡
B. 胃肠减压
C. 禁食
D. 吸氧
E. 抗感染治疗

正确答案：A。纠正水、电解质素乱和酸碱失衡

解析：肠梗阻时，胃肠道分泌的液体不能被吸收返回全身循环而积存在肠腔，同时肠壁继续有液体向肠腔内渗出，导致体液在第三间隙的丢失，伴随丢失大量电解质，导致水、电解质紊乱和酸碱失衡。此外，肠膨胀也可影响肠壁静脉回流，大量血浆渗出至肠腔和腹腔内，导致血容量下降。因此应及早给予液体补充血容量，并且纠正水、电解质紊乱和酸碱失衡。当血液生化检查结果尚未获得前，要先给予平衡盐液补充血容量。待有测定结果后再添加电解质，纠正水、电解质紊乱和酸碱失衡（A对）。禁食（C错）和胃肠减压（B错）目的是减少肠道内残留的气体、液体，减轻肠壁水肿，恢复肠壁血液循环，而非纠正水、电解质紊乱和酸碱失衡。吸氧有助于改善肺功能，提高血氧饱和度，增加组织氧供，也非纠正水、电解质紊乱和酸碱失衡（D错）。肠梗阻后肠黏膜受损引发的肠道细菌异位会导致感染，因此予以抗感染治疗，其目的也非水、电解质紊乱和酸碱失衡（E错）。